女，45岁，轻度肥胖，无明显口渴多饮和多尿现象，空腹血糖6.8mmol/L。为确定是否有糖尿病，应检查
A. 糖基化血红蛋白
B. 24小时尿糖定量
C. 口服葡萄糖耐量试验
D. 复查空腹血糖
E. 餐后2小时血糖

正确答案：C。口服葡萄糖耐量试验

解析：中年女性患者，轻度肥胖，无明显口渴多饮和多尿现象，空腹血糖6.8mmol/L。血糖高于正常范围（3.9～6.0mmol/L）而又未达到诊断糖尿病标准（空腹血糖≥7.0mmol/L）时，须进行OGTT（口服葡萄糖耐量试验）（C对）进一步诊断。糖化血红蛋白（A错）反映患者近8～12周平均血糖水平，不能反映瞬时血糖水平（P732），由于我国有关糖化血红蛋白诊断糖尿病的切入点的相关资料不足，目前尚不推荐采用糖化血红蛋白诊断糖尿病（P734）。24小时尿糖定量（B错）高于正常仅提示血糖值超过肾糖阈，肾脏病变时，肾糖阈升高，虽血糖升高，尿糖仍可正常，因此24小时尿糖定量无代表性。复查空腹血糖（D错）及餐后2小时血糖（E错）准确性不如口服葡萄糖耐量试验。